患儿，11岁，女。患甲状腺癌，并有颈淋巴结转移。医生告诉患儿母亲，女孩需做甲状腺癌根治术，按常规手术后要造成颈部塌陷变形、肩下垂，身体的外观和功能都要受到一定损害。当患儿母亲听到要造成这此后遗症后，断然拒绝治疗，带孩子出院。过了不久，患儿家属考虑到癌症将危及患者的生命，故再次来到医院，要求给子治疗，并请求医生尽可能不给孩子留下终身伤残的痛苦。医生经过再三考虑，决定打破常规，采用一种新的术式，既收到治疗效果，又使女孩子保留外形美观，功能不受破坏。患者及家属同意做此手术，尽管这种术式的治疗效果当时尚不能肯定。手术进行得很顺利，随访远期疗效也很好。在该事例中，涉及了患者权利的哪一项
A. 享有基本的医疗权
B. 享有自我决定权
C. 享有自我选择权
D. 享有知情同意权
E. 以上都是

正确答案：E。以上都是